某女，25岁。经期小腹冷痛，腰膝无力，血色暗淡，子宫虚冷。诊断为痛经，证属寒凝血瘀。宜选用的中成药是
A. 益母丸
B. 女金丸
C. 温经丸
D. 调经丸
E. 定坤丹

正确答案：C。温经丸

解析：本题考查的是痛经的辨证论治。经期小腹冷痛，腰膝无力，血色暗淡，子宫虚冷。诊断为痛经，证属寒凝血瘀。宜选用的中成药是温经丸（C对）。痛经是指女性正值经期或经行前后因胞宫气血变化，致病因素乘时而作所致的疾病，以周期性小腹疼痛，或痛引腰骶，甚则剧痛昏厥者为临床特征。（一）气滞血瘀证：【中成药应用】常用中成药有调经丸（D错）、元胡止痛片、益母丸（A错）、舒尔经颗粒。（二）寒凝血瘀证：【中成药应用】常用中成药有温经丸、少腹逐瘀丸、妇科万应膏。（三）湿热瘀阻证：【中成药应用】常用中成药有当归芍药颗粒、潮安胶囊。（四）气血虚弱证：【中成药应用】常用中成药有妇女养血丸、参茸白凤丸、八宝坤顺丸。（五）肝肾亏虚证：【中成药应用】常用中成药有安坤赞育丸、复方乌鸡口服液。女金丸（B错）为月经先期肾气虚证的中成药应用。月经先期肾气虚证：【中成药应用】常用中成药有女金丹丸。定坤丹（E错）为崩漏气血两虚证的中成药应用。崩漏气血两虚证：【中成药应用】常用中成药有定坤丹、乌鸡白凤丸、养血饮口服液。